34周早产儿，2100g，母亲胎膜早破，体温升高1小时剖宫产，生后评分5分，复苏后入住ICU，呼吸困难，青紫，逐渐加重，氧饱和度80%，PCO₂55mmHg，X片双肺通透度减低，肺肝界肺心界消失。诊断是
A. 胎粪吸入综合征
B. 新生儿湿肺
C. 新生儿肺炎
D. 新生儿呼吸窘迫综合征
E. 先天性膈疝

正确答案：D。新生儿呼吸窘迫综合征

解析：34周早产儿（常见发病年龄），2100g，母亲胎膜早破，体温升高1小时剖官产，生后评分5分，复苏后入住ICU，呼吸困难，青紫，逐渐加重（RDS表现），氧饱和度80%（正常值：100%，提示缺氧），PCO₂55mmHg（正常值：35-45mmHg，提示CO2潴留），X片双肺通透度减低，肺肝界肺心界消失（RDS特征性X线表现），结合患者的症状、实验室检查及影像学检查，考虑诊断是新生儿呼吸窘迫综合征（D对）。胎粪吸入综合征（A错）多有宫内窘迫史和（或）出生窒息史，于生后即开始出现呼吸窘迫。新生儿湿肺（B错）又称新生儿暂时性呼吸增快，多见于足月儿或剖宫产儿， 是由于肺内液体吸收及清除延迟所致，为自限性疾病，生后数小时内出现呼吸增快(＞ 60 ～8 0 次/分），但一般状态及反应较好，重者也可有青紫及呻吟等表现。新生儿肺炎（C错）母亲妊娠晚期多有感染、羊膜早破或羊水有异味史，外周血象、C反应蛋白、血培养等也可提示有感染证据。先天性膈疝（E错）一般生后不久表现为阵发性呼吸急促及青紫。腹部凹陷，患侧胸部呼吸音减弱甚至消失，可闻及肠鸣音；X线胸片可见患侧胸部有充气的肠曲或胃泡影及肺不张，纵隔向对侧移位。